治疗肝癌湿热瘀毒证，应首选
A. 疏肝理气，活血化瘀
B. 清热利湿，解毒破结
C. 养阴清热，解毒祛瘀
D. 理气化痰，消食散结
E. 温中散寒，健脾调胃

正确答案：B。清热利湿，解毒破结

解析：肝癌湿热瘀毒证，湿邪化热，聚而为毒，治宜清利湿热，化瘀解毒，代表方为茵陈蒿汤合鳖甲煎丸加减（B对）。疏肝理气，活血化瘀为肝癌气滞血瘀证的治法（A错）。养阴清热，解毒祛瘀为肝癌肝肾阴虚证的治法（C错）。理气化痰，消食散结为胃癌痰气交阻证的治法（D错）。温中散寒，健脾调胃为胃癌脾胃虚寒证的治法（E错）。